荔枝核除行气散结外，又能
A. 燥湿化痰
B. 开郁醒脾
C. 通阳散结
D. 祛寒止痛
E. 解毒消肿

正确答案：D。祛寒止痛

解析：本题考查的是荔枝核的功效。荔枝核除行气散结外，又能祛寒止痛（D对）。荔枝核：【功效】行气散结，祛寒止痛。化橘红：【功效】理气宽中，燥湿化痰（A错），消食。甘松：【功效】行气止痛，开郁醒脾（B错）。薤白：【功效】通阳散结（C错），行气导滞。青木香：【功效】行气止痛，解毒消肿（E错）。